女，40岁。瘢痕子宫，妊娠39周，规律宫缩8小时。宫口6cm，先露S=+1，突然腹痛加剧。查体：T37.5℃，P100次/分，BP90/60mmHg，宫口4cm，先露S=-2，胎心60次/分，2分钟后胎心消失。最可能的诊断是
A. 子宫破裂
B. 羊水栓塞
C. 胎盘早剥
D. 腹腔感染
E. 先兆子宫破裂

正确答案：A。子宫破裂

解析：中年女性患者，瘢痕子宫，妊娠39周，规律宫缩8小时。宫口6cm，先露S=+1，突然腹痛加剧。查体：T37.5℃，P100次/分，BP90/60mmHg，宫口4cm，先露S=-2，胎心60/分，2分钟后胎心消失。综合患者的症状、体征和辅助检查，最可能的诊断是子宫破裂（A对）。羊水栓塞（B错）表现为骤然出现的低氧血症、低血压（血压与失血量不符合）和凝血功能障碍。胎盘早剥（C错）常伴有妊娠期高血压疾病史或外伤史。腹腔感染（D错）表现为发热、呕吐、腹痛、腹泻、腹部压痛及反跳痛，腹肌紧张，腹腔引流物为脓性。先兆子宫破裂（E错），产妇烦躁不安，可见病理缩复环，膀胱受压充血时出现排尿困难及血尿。